四逆汤的组成是
A. 淡附片、生姜、炙甘草
B. 淡附片、干姜、炙甘草
C. 淡附片、炮姜、炙甘草
D. 柴胡、白芍、枳壳、甘草
E. 柴胡、赤芍、枳实、甘草

正确答案：B。淡附片、干姜、炙甘草

解析：本题考查的是四逆汤的药物组成。四逆汤的组成是淡附片、干姜、炙甘草（B对）。四逆汤：【药物组成】淡附片、干姜、甘草（炙）。四逆散：【药物组成】柴胡、白芍、枳壳（麸炒）、甘草（D错）。